主动脉瓣狭窄的典型三联征表现是
A. 呼吸困难-心绞痛-晕厥
B. 心力衰竭-心绞痛-晕厥
C. 呼吸困难-心力衰竭-晕厥
D. 心力衰竭-心律失常-晕厥
E. 心绞痛-心律失常-晕厥

正确答案：A。呼吸困难-心绞痛-晕厥

解析：八版内科学最新的观点认为主动脉瓣狭窄的典型三联征表现是心力衰竭-心绞痛-晕厥（B对）；而七版内科学认为主动脉瓣狭窄的典型三联征表现是呼吸困难-心绞痛-晕厥。知识点记忆应该以最新观点为准，本题正确答案为B。根据2018版大纲新，主动脉瓣狭窄典型三联征为呼吸困难、心绞痛和晕厥。